影响龋病患者的因素不包括
A. 饮食习惯
B. 地区不同
C. 人群的性别、民族差异
D. 气候条件
E. 年龄差异

正确答案：D。气候条件

解析：本题考查影响龋病患者的因素。气候条件（D错，为本题的正确答案）不同对龋病的发生没有影响。饮食习惯（A对）会影响糖及黏性食品的摄入量、摄入频率等，摄入量越高越易致龋。地区不同（B对）则水氟含量和经济状况有一定差异，水氟含量高的地区患龋率较低。人群的性别、民族差异（C对）影响患龋率，乳牙患龋率男性略高而恒牙患龋率女性略高；不同民族之间由于饮食习惯、人文、地理环境等不同导致患龋率有一定差异。年龄差异（E对）影响患龋率，乳牙、年轻恒牙和老年人牙龈退缩后的恒牙更易患龋。